表示固体制剂中药物溶出速度的公式是
A. Noyes-Whitney公式
B. Poiseuile公式
C. Henderson-Hasselbalch方程
D. Ostwald Freundlich方程
E. Arrhenius公式

正确答案：A。Noyes-Whitney公式

解析：本题考查固体药物的溶出速度。药物的溶出速度是指单位时间药物溶解进入溶液主体的量。固体药物的溶出速度主要受扩散控制，可用Noyes-Whitney方程（A对）表示。Poiseuile公式（B错）用于描述液体滤速与滤过效率关系。Henderson-Hasselbalch方程（C错）是关于弱酸弱碱性物质的解离型、非解离型及环境pH之间的关系。Ostwald Freundlich方程（D错）用于描述难溶性药物与粒子大小的定量关系。Arrhenius公式（E错）是预测药物稳定性的，反映温度与反应速度间的定量关系。